据某地疾病预防控制中心报告，该地近年来乙型肝炎发病率持续下降，人群分布应有的特点是
A. 儿童HBsAg阳性率出现明显降低趋势
B. 儿童感染率未出现明显降低趋势
C. 乙肝患者的治愈率明显提高
D. 乙肝患者的抗病毒治疗依从性明显提高
E. 乙肝患者的漏报明显降低

正确答案：A。儿童HBsAg阳性率出现明显降低趋势

解析：本题考查乙型肝炎的相关内容。乙肝疫苗免疫接种是预防和控制HBV感染的最有效的措施。乙肝疫苗的接种对象主要是新生儿。本题中该地近年来乙型肝炎发病率持续下降，人群分布应有的特点是儿童HBsAg阳性率出现明显降低趋势（A对BCDE错）。